某女，20岁。食海鲜后皮肤出现大小不等形状不一的风团，高起皮肤，边界清楚，色红，瘙痒，伴恶心，肠鸣泄泻，舌红，苔黄腻，脉滑数。除主穴外，应加取
A. 大椎、风门
B. 足三里、天枢
C. 风门、肺俞
D. 足三里、脾俞
E. 三阴交、风池

正确答案：B。足三里、天枢

解析：患者食海鲜后皮肤出现大小不等形状不一的风团，高起皮肤，边界清楚，瘙痒辨病为瘾疹，伴有“风团色红，恶心，肠鸣泄泻，舌红，苔黄腻，脉滑数可辨证为胃肠积热证”，治疗除主穴外应配足三里、天枢。足三里为足阳明合穴、胃之下合穴，可扶土而补中气；天枢为大肠募穴，理气止痛，活血散瘀，清利湿热（B对）。风热袭表配大椎；风寒袭表配风门（A错）。风门运化膀胱经气血上达头部；肺主皮毛，肺俞可清肺泄热（C错）。足三里为足阳明合穴、胃之下合穴，可扶土而补中气；脾俞补脾益气（D错）。三阴交为三阴经交会穴，可健脾利湿；风池可疏散在表的风邪（E错）。